治疗癲痫持续状态的首选药物是
A. 苯妥英钠
B. 苯巴比妥钠
C. 硫喷妥钠
D. 地西泮
E. 水合氯醛

正确答案：D。地西泮